关于肾上腺素的药理作用的说法正确的是
A. 作用于心肌，降低心肌耗氧量
B. 能够收缩血管，肾血管显著收缩
C. 给药以后迅速出现明显血压下降
D. 收缩支气管平滑肌
E. 降低支气管耗氧量，可使耗氧量减低20%

正确答案：B。能够收缩血管，肾血管显著收缩

解析：肾上腺素药理作用：①作用于心肌细胞，加强心肌收缩性，提高心肌代谢，使耗氧量增加；②激动血管平滑肌受体，使血管收缩，尤其是肾血管，也显著收缩；③给药后迅速出现升压作用，而后出现微弱的降压反应，后者持续时间较长；④可激动支气管平滑肌，舒张支气管平滑肌作用强大；⑤能够显著提高机体代谢，治疗剂量下，可使耗氧量升高20%～30%；⑥治疗量时一般无明显中枢兴奋作用，大剂量时中枢兴奋明显。掌握“肾上腺素”知识点。